β受体阻断药
A. 可使心率加快、心排出量增加
B. 有时可诱发或加重哮喘发作
C. 促进脂肪分解
D. 促进肾素分泌
E. 升高眼内压作用

正确答案：B。有时可诱发或加重哮喘发作

解析：β受体阻断剂的作用主要表现以下3个方面：心血管系统：通过阻断β₁受体而全面抑制心脏，主要表现为心率减慢，心肌收缩力减弱，心输出量减少（A错），心肌耗氧量下降；支气管平滑肌：非选择性的β受体阻断剂阻断支气管平滑肌的β₂受体，收缩支气管平滑肌而增加呼吸道阻力，对支气管哮喘或慢性阻塞性肺疾病的患者，有时可诱发或加重哮喘（B对）；代谢：抑制机体糖原和脂肪的分解（C错），拮抗其升高血糖和减少游离脂肪酸自脂肪组织的释放，通过阻断肾小球旁器细胞的β₁受体而抑制肾素的释放（D错）。β受体阻断剂可能通过阻断睫状肌的β受体，减少房水产生，从而降低眼内压（E错），治疗青光眼。